寇氏法的要求是
A. 各剂量组剂量呈等比级数排列
B. 各组小鼠不可少于10只
C. 最大剂量组死亡率100%，最低剂量组死亡率0
D. 动物数相同
E. 以上都是

正确答案：E。以上都是